口腔黏膜变态反应性疾病，不包括
A. 血管神经性水肿
B. 药物性口炎
C. 固定性药疹
D. 多形渗出性红斑
E. Riga-Fede病

正确答案：E。Riga-Fede病

解析：本题考查口腔黏膜变态反应性疾病。口腔黏膜变态反应性疾病，不包括Riga-Fede病（E错，为本题正确答案）。Riga-Fede病是专指发生于儿童舌腹的溃疡，因舌系带过短，新萌中切牙长期摩擦舌系带引起舌系带处充血、肿胀、溃疡，久不治疗则转变为肉芽肿性溃疡，扪诊有坚韧感，影响舌活动。它属于口腔黏膜溃疡性疾病。口腔黏膜变态反应性疾病包括药物过敏性口炎（B对）、多形红斑（D对）、斯-约综合征与中毒性表皮坏死松解症、接触性口炎、苔藓样损害、血管性水肿（A对）。固定性药疹（C对）指药物过敏引起的局限性的皮肤损害，常常由磺胺药、索米痛、解热镇痛药、巴比妥等引起。皮损主要发生在皮肤和黏膜交界的位置，比如口唇部位或者是生殖器的部位，不属于口腔黏膜变态反应性疾病。